热扰心神可见
A. 谵语
B. 呓语
C. 独语
D. 郑声
E. 口吃

正确答案：A。谵语

解析：热扰心神可见谵语，表现为神识不清，语无伦次，声高有力，属实证（A对）。呓语（B错）多因心火、胆热或胃气不和所致，久病虚衰出现呓语，称为虚呓，多为神不守舍所致。独语（C错）多因心气不足，神失所养，或气郁痰阻，蒙蔽心神所致，属阴证，常见于癫病、郁病。郑声（D错）多因久病脏气衰竭，心神散乱，见于多种疾病的晚期、危重阶段。口吃（E错）为语謇之一，因习惯而成者称为口吃，不属病态；病中语言謇涩，每与舌强并见者，多因风痰阻络所致，为中风之先兆或中风后遗症。